三岁女孩，无意中被发现左上腹有鹅蛋大包块质硬，随呼吸上下移动，应首先考虑
A. 肾结核
B. 肾积水
C. 脾肿大
D. 肾母细胞瘤
E. 胰腺囊肿

正确答案：D。肾母细胞瘤

解析：肾母细胞瘤是小儿最常见的恶性肿瘤，80%以上在5岁前发病。腹部肿块是肾母细胞瘤最常见、最重要的临床症状。肿块多位于上腹一侧季肋部，表面光滑，可有一定的活动度。因此，幼儿上腹部出现可移动腹部肿块，首先应当考虑肾母细胞瘤（D对）。肾结核多见于青壮年，婴幼儿少见（A错）。上尿路梗阻导致肾积水时，常伴显著的临床表现，如肾绞痛、恶心和呕吐等（B错）。